用于治疗良性前列腺增生，可减轻前列腺张力和膀胱出口梗阻的药物是
A. 奥昔布宁
B. 米多君
C. 坦索罗辛
D. 索利那新
E. 非那雄胺

正确答案：C。坦索罗辛

解析：本题考查良性前列腺增生症的药物治疗。α₁受体阻断剂（坦索罗辛）（C对）通过抑制前列腺和膀胱颈部平滑肌表面的肾上腺素能受体（主要是α1A和α1D），减轻前列腺张力和膀胱出口梗阻，达到减轻症状的目的。它的治疗优势在于数小时到数天后症状即有改善，不影响前列腺体积和血清PSA水平。